能够治疗敏感的G+球菌和杆菌、G-球菌及螺旋体所致感染的首选药是
A. 林可霉素
B. 红霉素
C. 青霉素
D. 链霉素
E. 四环素

正确答案：C。青霉素

解析：青霉素临床应用为肌注或静脉滴注，是敏感的G+球菌和杆菌、G-球菌及螺旋体所致感染的首选药物。掌握“红霉素及林可霉素”知识点。